以下哪条神经受损、拇指的运动和感觉功能不受影响
A. 桡神经浅支
B. 尺神经浅支
C. 正中神经
D. 桡神经深支
E. 尺神经深支

正确答案：D。桡神经深支

解析：尺神经浅支支配的是手尺侧皮肤感觉，不影响拇指感觉功能（B对），桡神经损伤，则出现前臂肌肉瘫痪，出现垂腕，伸指不能（包括拇指）。